某男，61岁。形体偏瘦，口干夜甚，习惯性便秘，大便数日1行，干结难下，舌微红少津。证属阴虚肠燥，宜选用的药有
A. 黄精
B. 沙苑子
C. 玄参
D. 知母
E. 生地黄

正确答案：A、C、D、E。黄精；玄参；知母；生地黄

解析：本题考查的是黄精、玄参、知母与生地黄的主治病证。形体偏瘦，口干夜甚，习惯性便秘，大便数日1行，干结难下，舌微红少津。证属阴虚肠燥，宜选用的药有黄精（A对）、玄参（C对）、知母（D对）与生地黄（E对）。黄精：【主治病证】（1）肺虚燥咳，劳嗽久咳。（2）肾虚精亏之腰膝酸软、须发早白、头晕乏力。（3）气虚倦怠乏力，阴虚口干便燥。（4）气阴两虚，内热消渴。玄参：【主治病证】（1）温病热入营血，温毒发斑。（2）热病伤阴之心烦不眠，阴虚火旺之骨蒸潮热。（3）咽喉肿痛，痈肿疮毒，瘰疬痰核，阳毒脱疽。（4）阴虚肠燥便秘。知母：【主治病证】（1）热病壮热烦渴。（2）肺热咳嗽，燥热咳嗽，阴虚劳嗽。（3）阴虚火旺，潮热盗汗。（4）内热消渴，阴虚肠燥便秘。生地黄：【主治病证】（1）温病热入营血证。（2）血热之吐血、衄血、尿血、崩漏下血。（3）热病后期伤阴，阴虚发热，内热消渴。（4）阴虚肠燥便秘。沙苑子（B错）：【主治病证】（1）肾虚腰痛，阳痿遗精，遗尿尿频，白带过多。（2）肝肾亏虚之目暗不明、头昏眼花。